5-FU是哪种碱基的类似物
A. A
B. U
C. C
D. G
E. T

正确答案：E。T